正确描述角膜的是
A. 其本身的颜色有明显的种族差异
B. 有血管分布
C. 有感觉神经末梢分布
D. 占眼外膜的大部分
E. 向前以乳突窦入口通向前庭

正确答案：C。有感觉神经末梢分布

解析：角膜占眼球纤维膜的前1/6，即占眼外膜的小部分，而非大部分（D错），无血管分布（B错），但有感觉神经末梢分布（C对）。本身的颜色有明显的种族差异（A错）的是虹膜，而非角膜。